目前中药定量分析使用数量最多的方法是
A. 薄层色谱法
B. 高效液相色谱法
C. 气相色谱法
D. 紫外-可见分光光度法
E. 原子吸收分光光度法

正确答案：B。高效液相色谱法

解析：本题考查的是含量测定的方法。目前中药定量分析使用数量最多的方法是高效液相色谱法（B对）。高效液相色谱法（HPLC）：HPLC法是目前中药含量测定中最常用的方法。《中国药典》一部中采用HPLC法进行含量测定的有2236项，占所有含量测定项数的86.5%。HPLC的定量分析方法主要有内标法、外标法、主成分自身对照法、面积归一化法，此外还有新采用的一测多评法。薄层色谱法（A错）可用于分离、定性及定量测定。气相色谱法（C错）（GC）的测定对象主要是易于挥发、热稳定性好的样品，如含挥发油或其他挥发性成分的中药。紫外-可见分光光度法（D错）的定量方法主要有吸收系数法、标准曲线法和对照品比较法。原子吸收分光光度法（E错）（AAS）的测定对象是呈原子状态的金属元素和部分非金属元素，主要用于中药中Ca、Fe、Zn、Mn、Cu、Pb、Se、Cd、As等元素的测定，是中药中有害元素及矿物药测定的常用方法。